主要发生自牙胚成釉上皮的剩余细胞的是
A. 唇癌
B. 颊黏膜癌
C. 口底癌
D. 上颌窦癌
E. 中央性颌骨癌

正确答案：E。中央性颌骨癌

解析：中央性颌骨癌主要发生自牙胚成釉上皮的剩余细胞。掌握“中央性颌骨癌及上颌窦癌”知识点。